思想文化影响人类健康的主要途径是
A. 影响人类的劳动条件
B. 影响人类的科学技术水平
C. 支配人们的行为生活方式
D. 干扰人们的心理过程
E. 干扰人们的心理过程和精神生活

正确答案：E。干扰人们的心理过程和精神生活

解析：本题考查思想文化影响人类健康的主要途径。思想文化包括文学艺术、宗教信仰、思想意识等，主要通过影响心理过程和精神生活（E对ABCD错）作用于人群健康。